急性心肌梗死可发生
A. 心源性休克
B. 充血性心力衰竭
C. 两者均有
D. 两者均无
E. 无

正确答案：A。心源性休克

解析：急性心肌梗死时，心肌细胞缺血缺氧，发生变性坏死，心肌收缩功能降低，导致心输出量不足，动脉血压下降，严重时可发生心源性休克（A对）。